患者，男，60岁。脑出血后长期卧床，2天前出现发热，咳嗽，呼吸困难等症状，胸透见两肺下叶有散在的边缘不清小灶阴影应首先考虑的是
A. 大叶性肺炎
B. 干酪样肺炎
C. 间质性肺炎
D. 转移性肿瘤
E. 小叶性肺炎

正确答案：E。小叶性肺炎

解析：患者脑出血后出现发热咳嗽，呼吸困难，胸透见两肺下叶有散在的边缘不清小灶阴影应首先考虑的是小叶性肺炎，是因为肺组织炎症使呼吸膜增厚及下呼吸道阻塞而导致通气与换气功能障碍（E对）。大叶性肺炎临床症状有突然寒战、高热、咳嗽、胸痛、咳铁锈色痰。血白细胞计数增高；典型的X线表现为肺段、叶实变（A错）。干酪样肺炎.反复咳嗽、咳痰、咳血、发热、胸痛，右胸前有时可闻少许湿罗音。胸部X线检查，可行后前位、右侧位、前弓位摄片，可见中叶区呈三角形的密度增高阴影（B错）。间质性肺炎主要的临床表现为呼吸困难（气短），疾病早期仅在活动时出现，随着疾病进展，病情逐渐加重；其次是咳嗽，多为持续性干咳；部分患者还可能伴有发热、乏力等全身症状（C错）。转移性肿瘤临床兼有原发癌症状及转移癌本身引起症状，一般先有原发癌症状，晚期才出现转移癌症状。早期无特异症状，有乏力、消瘦、肝区痛、继而为肝大、黄疸、腹水、发热等。此外，CEA高值有一定意义（D错）。